高血压病人在确诊，自行改善高盐饮食的习惯，若选择这样的人群为病例组，进行病例对照研究探讨摄盐量与高血压之间的关系，则可以出现
A. 伯克森偏倚
B. 奈曼偏倚
C. 易感性偏倚
D. 检出症候偏倚

正确答案：B。奈曼偏倚

解析：本题考查奈曼偏倚。高血压病人在确诊，自行改善高盐饮食的习惯，若选择这样的人群为病例组，进行病例对照研究探讨摄盐量与高血压之间的关系，则可以出现奈曼偏倚（B对ACD错）。高血压病人由于疾病而改变了原有的一些暴露特征（如生活习惯），当他们被调查时容易误将这些改变了的暴露特征当作疾病前的状况，从而导致这些因素与疾病的关联误差。